上颌第一磨牙（牙合）面形态中哪一点是错误的
A. 斜方形
B. 近中颊（牙合）角及远中舌（牙合）角是锐角
C. 可见斜嵴
D. 5条发育沟
E. 近中窝大于远中窝

正确答案：D。5条发育沟

解析：本题考查上颌第一磨牙牙合面的形态特点。5条发育沟（D错，为本题正确答案）不符合上颌第一磨牙牙合面的形态特点。上颌第一磨牙牙合面发育沟主要有三条，分别为颊沟、近中沟和远中舌沟。牙合面结构复杂，尖窝起伏，沟嵴交错，外形轮廓呈斜方形（A对）。近中颊牙合角及远中舌牙合角为锐角（B对）；远中颊牙合角及近中舌牙合角为钝角。近中舌尖三角嵴与远中颊尖三角嵴斜形相连形成斜嵴（C对），是上颌第一磨牙的解剖特征。远中舌尖三角嵴较小，自其牙尖顶端斜向颊侧略偏近中至牙合面中央。牙合面的中部凹陷成窝，主要的窝有三个，中央窝、近中窝及远中窝，大小依次为中央窝＞近中窝＞远中窝（E对）。